不属于我国社会主义医德基本原则内容的一项是
A. 中西医并重
B. 廉洁奉公
C. 救死扶伤
D. 实行社会主义人道主义
E. 全心全意为人民身心健康服务

正确答案：A。中西医并重

解析：1988年，我国卫生部公布的《医务人员医德规范及实施办法》是医学伦理学的基本规范，其具体内容是：①救死扶伤，实行社会主义的人道主义。时刻为病人着想，千方百计为病人解除病痛。②尊重病人的人格与权利，对待病人，不分民族、性别、职业、地位、财产状况，都应一视同仁。③文明礼貌服务。举止端庄，语言文明，态度和蔼，同情、关心和体贴病人。④廉洁奉公。自觉遵纪守法，不以医谋私。⑤为病人保守医密，实行保护性医疗，不泄露病人隐私与秘密。⑥互学互尊，切结协作。正确处理同行同事间的关系。⑦严谨求实，奋发进取，钻研医术，精益求精。不断更新知识，提高技术水平。掌握“医学伦理的指导原则”知识点。